女，45岁，左下肢沉重感伴浅静脉扩张，长时间站立加重，休息后减轻，既往高血压病史5年，查体：左下肢小腿内侧局部皮肤色素沉着，皮下可触及硬结，大隐静脉瓣膜功能试验（＋），最可能的诊断是
A. 动脉硬化性闭塞症
B. 原发性深静脉瓣膜功能不全
C. 动静脉瘘
D. 原发性下肢静脉曲张
E. 下肢血栓性浅静脉炎

正确答案：D。原发性下肢静脉曲张

解析：女性患者，左下肢沉重感，浅静脉扩张，长时间站立加重，休息后减轻，左下肢小腿内侧局部皮肤色素沉着，皮下可触及硬结，大隐静脉瓣膜功能试验（＋），最可能的诊断是原发性下肢静脉曲张（D对）。动脉硬化性闭塞症（A错）发生在大、中动脉，早期症状为病肢冷感、苍白，进而出现间歇性跛行。后期，病肢皮温明显降低、色泽苍白或发绀，出现静息痛，肢体远端缺血性坏疽或溃疡（P487）。原发性深静脉瓣膜功能不全（B错）：症状相对严重，超声或下肢静脉造影，观察到深静脉瓣膜关闭不全的特殊征象（P501）。动静脉瘘（C错）：病肢皮肤温度升高，局部有时可们及震颤或有血管杂音，浅静脉压力明显上升，静脉血的含氧量增高（P501）。下肢血栓性浅静脉炎（E错）局部可扪及伴触痛的索状物，可有表面皮肤红肿（P485）。